幼儿应选择的适宜的牙刷刷牙，下列选项中不正确的是
A. 刷毛应较软
B. 小刷头的牙刷
C. 刷毛末端应磨圆
D. 刷毛排列合理
E. 牙刷柄应尽量长

正确答案：E。牙刷柄应尽量长

解析：父母应选择适合儿童年龄的牙刷，最好是刷头小、刷毛软、刷毛末端经过磨圆的儿童阶段牙刷，早晚帮助儿童刷牙，使儿童逐渐习惯和适应口腔清洁过程。掌握“婴幼儿的口腔保健”知识点。